药用部位为子实体的药材是
A. 冬虫夏草
B. 茯苓
C. 灵芝
D. 猪苓
E. 雷丸

正确答案：C。灵芝

解析：本题考查的是菌类中药的药用部位。药用部位为子实体的药材是灵芝（C对）。菌类中药：药用部位主要为真菌的菌核（茯苓（B错）、猪苓（D错）、雷丸（E错））、子实体（灵芝、马勃）或子座与幼虫尸体的复合体（冬虫夏草（A错））的中药，称为菌类中药。